肛隐窝炎的并发症
A. 肛口肿胀
B. 肛口疼痛
C. 肛口出血
D. 肛乳头炎
E. 肛口潮湿

正确答案：D。肛乳头炎

解析：肛隐窝底部有肛腺的开口，因特殊的解剖结构，肛隐窝引流较差，且容易受到损伤，当发生炎症时，局部充血、水肿、分泌物增多和组织增生等。由于炎症的慢性刺激，常可并发肛乳头炎（D对）、肛乳头肥大，甚者可通过肛腺开口蔓延，形成肛门直肠周围脓肿。 肛隐窝炎是指肛隐窝、肛门瓣发生急慢性炎症性疾病，又称肛窦炎。肛门部不适、坠胀（A错）疼痛（B错）、甚至有分泌物及潮湿（E错）、瘙痒等是其临床主要表现，不是其并发症，肛隐窝炎的并发症中无肛口出血（C错）。